判断乳腺包块周围血供情况的首选方法是
A. 乳腺MRI
B. 乳腺B超
C. 钼钯摄片
D. PET-CT
E. CT

正确答案：B。乳腺B超

解析：乳腺B超（B对）结合彩色多普勒可观察病变或脏器内部的血流分布、走行及形态，并可以对有关血流动力学参数进行测量。乳腺MRI（A错）具有极好的软组织分辨率且无射线辐射，运用动态增强技术可提供病灶的血流动力学情况，但其操作相对繁琐且费用高，一般不作为首选。钼钯摄片（C错）广泛用于乳腺癌筛查，主要用于检出肿块，无法判断乳腺血流。PET-CT（D错）很少用于乳腺包块的检查。CT（E错）平扫无法判断乳腺血流，增强扫描可观察乳腺血供情况及有无异常强化，但乳腺CT检查并不常用。